分子中含有季铵结构，中枢作用较弱的药物是
B. 硫酸阿托品
C. 氢溴酸东莨菪碱
D. 氢溴酸山莨菪碱
E. 丁溴东莨菪碱

正确答案：E。丁溴东莨菪碱

解析：本题考查药物的化学结构及药理作用。分子中含有季铵结构，中枢作用较弱的药物是丁溴东莨菪碱（E对）。丁溴东莨菪碱是抗胆碱药，可缓解胃肠道、胰胆管平滑肌痉挛，用于治疗胃肠痉挛、蠕动亢进、胆绞痛、肾绞痛等，分子中含有季铵结构，对中枢作用弱。氢溴酸后马托品（A错）、硫酸阿托品（B错）、氢溴酸东莨菪碱（C错）、氢溴酸山莨菪碱（D错）都是抗胆碱药，分子中不含有季铵结构。